经骶管裂孔穿出的神经是
A. 1~5骶神经
B. 1~4骶神经
C. 尾神经
D. 第5骶神经和尾神经
E. 无

正确答案：D。第5骶神经和尾神经

解析：第1~4骶神经（B错）从同序数的骶前孔和骶后孔出骶管。第5骶神经和尾神经则经骶管裂孔穿出（D对）。